青霉素可以特异性抑制的酶是
A. 单胺氧化酶
B. 胆碱酯酶
C. 甲状腺过氧化物酶
D. 黏肽代谢酶
E. 血管紧张素转化酶

正确答案：D。黏肽代谢酶

解析：本题考查青霉素的作用机制。青霉素可以特异性抑制的酶是黏肽代谢酶（D对）。单胺氧化酶（A错）可使去甲肾上腺素灭活。新斯的明能够可逆性抑制胆碱酯酶（B错）。丙硫氧嘧啶能抑制过氧化酶系统（C错）。卡托普利等ACEI制剂抑制血管紧张素转化酶（E错）。